组织屏障不包括
A. 皮肤屏障
B. 黏膜屏障
C. 血脑屏障
D. 胎盘屏障
E. 角膜屏障

正确答案：E。角膜屏障

解析：组织屏障包括皮肤黏膜屏障、血脑屏障和胎盘屏障。掌握“免疫应答基本概念、固有及适应性免疫应答”知识点。